最常见的口腔癌是
A. 舌癌
B. 牙龈癌
C. 颊癌
D. 唇癌
E. 口底癌

正确答案：A。舌癌

解析：本题考查最常见的口腔癌。舌癌（A对）是最常见的口腔癌，多发生于舌缘，其次为舌尖、舌背，常为浸润型或溃疡型，一般恶性程度较高，生长快，浸润性较强，常波及舌肌，致舌运动受限。牙龈癌（B错）发病率低于舌癌，在口腔癌中居第二位或第三位，早期肿瘤可侵犯牙槽突及颌骨，出现牙齿松动、移位，甚至脱落，局部伴有疼痛。颊癌（C错）也是常见的口腔癌之一，在口腔癌中居第二或第三位，多为分化中等的鳞状细胞癌，少数为腺癌及恶性多形性腺瘤。唇癌（D错）为发生于唇红缘黏膜的癌，多发生于下唇中外1/3间的唇红缘部黏膜，发生率较舌癌低。口底癌（E错）系指原发于口底黏膜的癌，较为少见，占口腔癌及唇癌的第六位。